某男，35岁。五一假期外出旅游，因天气忽冷忽热而感冒，症见发热、头痛、咳嗽、口干、咽喉疼痛，舌淡红、苔薄黄、脉浮数。医师诊断为风热感冒，并处以银翘解毒颗粒。服用3天，诸症悉除。银翘解毒颗粒处方的组成有金银花、连翘、薄荷、荆芥、淡豆豉、炒牛蒡子、淡竹叶、桔梗、甘草。方中淡豆豉除解表外，又能
A. 止痛
B. 解毒
C. 利尿
D. 除烦
E. 化湿

正确答案：D。除烦

解析：本题考查淡豆豉的功效。方中淡豆豉除解表外，又能除烦（D对）。淡豆豉【功效】解表，除烦。防风【功效】祛风解表，胜湿，止痛（A错），解痉。土茯苓【功效】解毒（B错），利湿，通利关节。竹叶【功效】清热除烦，生津，利尿（C错）。广藿香【功效】化湿（E错），止呕，发表解暑。